类胡萝卜素在体内可转变成哪种维生素
A. 维生素D
B. 维生素A
C. 维生素E
D. 维生素K
E. 维生素B₂

正确答案：B。维生素A